治疗不孕症血瘀证，应首选
A. 当归补血汤
B. 补阳还五汤
C. 少腹逐瘀汤
D. 桃红四物汤
E. 通窍活血汤

正确答案：C。少腹逐瘀汤

解析：不孕血瘀证表现为婚久不孕，月经后期，经量多少不一，色紫夹块，经行不畅，小腹疼痛拒按，或腰骶疼痛，少腹逐瘀汤可以活血化瘀，调理冲任，治疗不孕症的血瘀证（C对）。当归补血汤（A错）适用于气血两虚证。补阳还五汤（B错）适用于气虚血瘀证。桃红四物汤（D错）适用于因虚致瘀，月经过多的血瘀证。通窍活血汤（E错）适用于头痛血瘀证。